下列有关龋病药物疗法的叙述中，不正确的是
A. 氟化物对软组织无腐蚀性
B. 硝酸银一般只用于乳牙和后牙
C. 75%氟化钠甘油糊剂是常用的氟化物
D. 氟化物不使牙变色
E. 硝酸银可用于牙颈部龋

正确答案：E。硝酸银可用于牙颈部龋

解析：常用的氟化物有75%氟化钠甘油糊剂、8%氟化亚锡溶液、酸性磷酸氟化钠（APF）溶液、含氟凝胶及含氟涂料等。氟化物对软组织无腐蚀性，不使牙变色，前后牙均可使用。硝酸银对软组织有强的腐蚀性，并使牙变黑，一般只用于乳牙和后牙，不可用于牙颈部龋。掌握“龋病的治疗原则与非手术治疗方法”知识点。